选择性扩张脑血管的药物是
A. 硝苯地平
B. 地尔硫䓬
C. 哌替啶
D. 氟桂嗪
E. 维拉帕米

正确答案：D。氟桂嗪

解析：本题考查钙通道阻滞药。选择性扩张脑血管的药物是氟桂嗪（D对），属于非选择性钙通道调节药, 可阻滞各种病因刺激下过量的钙离子跨膜进入细胞内而造成细胞损伤或死亡，对血管平滑肌有直接扩张作用，能显著改善脑循环及冠脉循环，对心脏慢钙通道无阻滞作用，故对心脏收缩和传导无影响。对脑血管的扩张作用较好，而对心肌血管的扩张作用较差，不影响心率及血压。硝苯地平（A错）为二氢吡啶类钙通道阻滞剂，扩张外周血管作用较强，可用于控制严重的高血压，或伴有冠心病的高血压患者，亦可用于心绞痛、雷诺病的治疗，宜与β受体阻滞剂普萘洛尔合用，以消除硝苯地平因扩张血管作用所产生的反射性心动过速。地尔硫䓬（B错）属于苯并噻氮䓬类钙通道阻滞剂，可用于轻度及中度高血压，稳定性心绞痛及不稳定型心绞痛、室上性心动过速、雷诺病等的治疗。尼莫地平（C错）为二氢吡啶类钙通道阻滞剂，扩张外周血管作用较强，可用于控制严重的高血压，对脑血管较敏感，能增加脑血流量，可用于伴有脑血管病的高血压患者，及可预防由蛛网膜下腔出血引起的脑血管痉挛及脑栓塞。维拉帕米（E错）为苯烷胺类钙通道阻滞剂，可用于轻度及中度高血压，或伴有快速型心律失常的高血压患者，还可用于心绞痛、室上性心动过速等的治疗，可减缓肿瘤细胞对抗肿瘤药物的耐药性，用作肿瘤耐药性逆转剂。